某些环境污染物，在体内的浓度随时间的变化，只有在体内浓度达到中毒同值时，才会产生危害，这种污染物具有
A. 潜隐性
B. 蓄积性
C. 迟发性
D. 时间性
E. 暴发性

正确答案：B。蓄积性

解析：本题考查污染物的蓄积性。某些环境污染物，在体内的浓度随时间的变化，只有在体内浓度达到中毒同值时，才会产生危害，这种污染物具有蓄积性（B对ACDE错）。